在社区开展口腔健康调查的目的不是为了
A. 掌握口腔健康基线资料
B. 将来评估预防项目时可以对比
C. 了解人群口腔患病状况
D. 设计预防项目的需要
E. 计算机统计资料的需要

正确答案：E。计算机统计资料的需要

解析：本题考查在社区开展口腔健康调查的目的。计算机统计资料是为了方便数据分析与记录，而不是单纯的为了计算机统计资料的需要（E错，为本题的正确答案）。口腔健康状况调查的目的有：1.查明口腔疾病在特定时间内的发生频率和分布特征及其流行规律，以掌握口腔健康基线资料（A对），了解人群口腔患病状况（C对）。2.了解和分析影响口腔健康的有关因素。3.为探索病因，建立和验证病因假设提供依据。4.选择预防保健措施和评价病因提供依据,将来评估预防项目时可以对比（B对），满足设计预防项目的需要（D对）。5.评估治疗与人力需要。